患者，女，21岁。食鱼虾后皮肤出现片状风团，瘙痒异常。治疗取神阙穴，所用的方法是
A. 针刺
B. 隔盐灸
C. 拔罐
D. 隔姜灸
E. 艾条灸

正确答案：C。拔罐

解析：患者食鱼虾后皮肤出现片状风团，瘙痒异常，为食物过敏的现象，属中医瘾疹。神阙穴一般不针（A错）。瘾疹治宜疏风和营，病在营血。隔盐灸有回阳、救逆、固脱的功效（B错）。瘾疹可用拔罐法治疗，在神阙穴拔火罐，留罐5分钟，取下再拔罐留5分钟，如此3次为1次治疗（C对）。隔姜灸有温胃止呕，散寒止痛的功效（D错）。艾条灸有温经散寒，扶阳固脱，消瘀散结的功效（E错）。